舌淡白胖嫩，苔白滑者，常提示
A. 阴虚夹湿
B. 脾胃湿热
C. 气分有湿
D. 阳虚水停
E. 瘀血内阻

正确答案：D。阳虚水停

解析：阳气亏虚，血液运行无力，水湿内停，以致舌胖嫩色淡白湿润。苔薄白而滑者，大多是外感寒湿，或脾肾阳虚，水湿内停（D对）。阴虚，虚火上炎，舌体脉络涌沸，故舌色鲜红。湿浊之邪困于体内见苔白腻（A错）。湿热或痰热内蕴，则黄苔而质腻（B错）。湿热之邪侵入气分（C错），以身热不扬，胸闷腹胀，身目发黄，四肢困倦，尿黄，舌红苔黄腻，脉滑数等为常见症状。瘀血内阻（E错）则见舌色青紫，甚或舌面局部瘀点或瘀斑。